休克时应用血管活性药物的最主要目的是
A. 提升血压
B. 扩张微血管
C. 降低血液粘度
D. 减低血流阻力
E. 提高微循环灌流量

正确答案：E。提高微循环灌流量

解析：提高微循环灌流量（E对ABCD错）是休克时应用血管活性药物的最主要目的 。